急性肾功能衰竭少尿期的表现正确的是
A. 低钾
B. 高氯
C. 高钠
D. 低钙
E. 低镁

正确答案：D。低钙

解析：急性肾功能衰竭少尿期会出现如下电解质紊乱：①因肾排泄钾减少、酸中毒、组织分解过快会导致高钾血症（A错）；②因肾小球滤过率下降导致水潴留，导致稀释性低钠（C错）及低氯（B错）；③肾排镁减少，导致高镁（E错），因血镁与血钙是相互拮抗的关系，因此当血镁升高，血钙降会降低导致低钙（D对）。